蛋白质-热能营养不良恢复期常见并发的维生素缺乏是
A. 维生素A₁
B. 维生素B₁
C. 维生素C
D. 维生素D
E. 维生素E

正确答案：D。维生素D

解析：蛋白质-热能营养不良恢复期常见并发的维生素缺乏是维生素D，因为营养不良时，骨骼生长发育不明显，而恢复期时生长发育加快，骨骼生长发育明显，骨骼生长需要的微量元素是维生素D，因此PEM恢复期常见并发的维生素缺乏是维生素D（D对）。